在牙齿发育期间，由于全身疾病、营养障碍或严重的乳牙根尖周感染，导致的釉质结构异常称为
A. 四环素牙
B. 牙本质发育不全
C. 牙釉质发育不全
D. 桑葚牙
E. 牙内陷

正确答案：C。牙釉质发育不全

解析：在牙齿发育期间，由于全身疾病、营养障碍或严重的乳牙根尖周感染，导致的釉质结构异常称为牙釉质发育不全。掌握“釉质发育不全”知识点。